意外穿髓，穿髓孔直径＜0.5mm的恒牙可选用
A. 间接盖髓术
B. 直接盖髓术
C. 安抚治疗后永久充填
D. 双层垫底后永久充填
E. 局部麻醉下开髓引流

正确答案：B。直接盖髓术

解析：本题考查直接盖髓术的适应证。直接盖髓是用药物覆盖牙髓暴露处，以保护牙髓，保存牙髓活力，可用于外伤性露髓、机械性露髓和龋源性露髓的治疗（B对）。间接盖髓适用于深龋、外伤近髓的患牙，牙髓并未暴露，或可复性牙髓炎及慢性牙髓炎和可复性牙髓炎的诊断性治疗（A错）。安抚治疗适用于深龋患者，无自发痛，但有明显激发痛，备洞过程极其敏感（C错）。双层垫底用于深的窝洞距离髓腔很近，先用氧化锌粘固剂或氢氧化钙，再垫聚羧或玻璃子粘固剂（D错）。局麻下开髓引流用于治疗急性牙髓炎（E错）。